男性，36岁，被火焰烧伤2小时，估计深Ⅱ度面积15%，Ⅲ度面积25%，患者入院经清创、抗休克治疗，病情稳定。3天后该患者病情进一步好转，其下一步最恰当的治疗应是
A. 继续补液、抗休克
B. 联合应用抗生素抗感染
C. 创面湿敷，使焦痂脱落
D. 分期切除焦痂，创面植皮
E. 待焦痂干周脱落再处理

正确答案：D。分期切除焦痂，创面植皮

解析：该患者是重度烧伤，经抢救性治疗，现已渡过休克期，3天后将转入感染期，治疗上应重点在预防和治疗感染，其关键是对烧伤焦痂与深Ⅱ°痂皮的处理。该患者烧伤创面需有计划地切除焦痂与深Ⅱ°痂皮，才能防止痂下感染，避免全身化脓性感染。掌握“火器伤、热烧伤”知识点。